既燥湿化痰，又祛风止痉的药是
A. 橘红
B. 半夏
C. 蝉蜕
D. 天南星
E. 牛黄

正确答案：D。天南星

解析：本题考查的是天南星的功效。既燥湿化痰，又祛风止痉的药是天南星（D对）。天南星：【功效】燥湿化痰，祛风止痉，散结消肿。橘红（A错）：【功效】行气宽中，燥湿化痰，发表散寒。半夏（B错）：【功效】燥湿化痰，降逆止呕，消痞散结。蝉蜕（C错）：【功效】疏散风热，透疹止痒，明目退翳，息风止痉。牛黄（E错）：【功效】清热解毒，息风止痉，化痰开窍。